引起急性胰腺炎最常见的原因是
A. 胰腺外伤
B. 急性黄疸型肝炎
C. 胆总管末端梗阻和胆汁逆流
D. 流行性腮腺炎
E. 穿透性消化性溃疡

正确答案：C。胆总管末端梗阻和胆汁逆流

解析：引起急性胰腺炎最常见的原因是胆总管末端梗阻和胆汁逆流，是由于胆管下端明显梗阻，胆道内压力甚高，高压的胆汁逆流胰管，造成胰腺腺泡破裂，胰酶进入胰腺间质而发生胰腺炎（C对）。胰腺外伤使胰腺管破裂、胰腺液外溢以及外伤后血液供应不足，导致发生急性重型胰腺炎（A错）。急性黄疸型肝炎主要是引起肝损伤、积聚鼓胀等（B错）。流行性腮腺炎引起的并发症是脑膜炎、睾丸炎、卵巢炎、轻型和亚临床型胰腺炎（D错）。穿透性消化性溃疡以穿透胰腺者多见，当穿透胰腺时多有向腰背部的放散痛，疼痛部位较深，有的伸腰时疼痛加重（E错）。